男，59岁。2型糖尿病病史7年，口服格列本脲15mg/d和二甲双胍2.0g/d治疗。8个月前眼底检查可见微血管瘤、出血和硬性渗出。近1个月来视力明显减退，眼底检查可见视网膜新生血管形成和玻璃体积血。BP160/100mmHg，BMI28.4空腹血糖7.1mmmol/L，餐后2小时血糖14.6mmol/L，糖化血红蛋白7.6%。对该患者糖尿病视网膜病变最合适的治疗为
A. 降血压治疗
B. 抗纤溶治疗
C. 激光治疗
D. 扩血管治疗
E. 抗凝治疗

正确答案：C。激光治疗

解析：中老年男性患者，2型糖尿病7年病史，近一个月来视力明显减退，眼底检查可见视网膜新生血管形成和玻璃体积血，依据2002年国际临床分级标准，本例患者眼底检查符合糖尿病视网膜病变Ⅳ期，对该患者糖尿病视网膜病变最合适的治疗为视网膜激光治疗（C对）。糖尿病视网膜病变致盲的原因是严重的增殖性视网膜病变导致的玻璃体出血和牵拉性视网膜脱离。及时的激光治疗可以改善视网膜缺血缺氧状态，促使新生血管萎缩，增殖性视网膜病变停止或消退，从而防止发生玻璃体出血及视网膜脱离。降血压治疗（A错）、扩血管治疗（D错）都是高血压的对症治疗，不能改善糖尿病视网膜病变。抗纤溶治疗（B错）、抗凝治疗（E错）主要用于糖尿病大血管病变—动脉粥样硬化的预防。